与黏膜免疫应答密切相关的免疫球蛋白是
A. IgG
B. IgA
C. IgE
D. IgD
E. IgM

正确答案：B。IgA

解析：IgA有血清型和分泌型两型，其中分泌型IgA（B对）（SIgA）与黏膜免疫应答密切相关。IgG（A错）（P35）参与再次免疫应答的产生，在新生儿抗感染免疫中起重要作用，参与补体活化，具有调理作用、ADCC作用等。IgE（C错）（P37）参与Ⅰ型超敏反应，机体抗寄生虫免疫。IgD（D错）（P37）分为两型：血清型IgD的生物功能尚不清楚；膜结合型IgD是B细胞分化发育成熟的标志。IgM（E错）（P36）是个体发育过程中最早合成和分泌的抗体，也是初次体液免疫应答中最早出现的症状，是机体抗感染的“先头部队”；血清中检出病原体特异性IgM，提示新近发生感染，可用于感染的早期诊断。